小儿腹泻阴竭阳脱证的治疗方剂为
A. 葛根黄芩黄连汤加减
B. 藿香正气散加减
C. 保和丸加减
D. 人参乌梅汤加减
E. 生脉散合参附龙牡救逆汤加减

正确答案：E。生脉散合参附龙牡救逆汤加减

解析：小儿腹泻阴竭阳脱证是由于泻下过度，气阴两伤，阴伤及阳所致，治疗时应挽阴回阳，救逆固脱，首选生脉散合参附龙牡救逆汤加减（E对）。葛根黄芩黄连汤（A错）其功用为解表清里，适用于腹泻之湿热泻。藿香正气散（B错）其功用为解表化湿，理气和中，适用于腹泻之风寒泻。保和丸（C错）其功用为消食和胃，适用于腹泻之伤食泻。人参乌梅汤（D错）其功用为酸甘化阴，健脾止痢，适用于腹泻之气阴两伤证。